右上2缺失，间隙3mm，右上3近中（牙合）面龋，根充完善，下颌对（牙合）牙为局部义齿，修复右上2最好的设计是
A. 活动义齿
B. 半固定桥
C. 单端固定桥
D. 双端固定桥
E. 种植义齿

正确答案：C。单端固定桥

解析：选择单端固定桥有以下原因：间隙3mm；桥体短，受力小；右上3近中（牙合）面龋，根充完善；3需要做冠，同时支持力好；下颌对（牙合）牙为局部义齿说明对（牙合）咬合力小。以上三点就是单端固定桥的要求。掌握“固定桥的组成和分类”知识点。